下列疾病中，最容易并发骨筋膜室综合征的是
A. 肩关节后脱位
B. 桡骨远端骨折
C. 股骨干骨折
D. 肱骨髁上骨折
E. 髋关节后脱位

正确答案：D。肱骨髁上骨折

解析：骨筋膜室由骨、骨间膜、肌间隔和深筋膜形成，室内肌肉和血管因急性缺血而产生一系列早期综合征称为骨筋膜室综合征，最多见于前臂和小腿。伸直型肱骨髁上骨折（D对）由于近折端向前下移位，极易压迫或刺破肱动脉，加上损伤后的组织反应，局部肿胀严重，均会影响远端肢体血液循环，导致骨筋膜室综合征。关节脱位（AE错）引起的肿胀一般不会引起肢体远端的血供障碍，故不会形成骨筋膜室综合征。股骨干骨折（C错）只有当发生在下1/3段时，由于远折端向后移位，有可能损伤腘动脉、腘静脉和胫神经、腓总神经，引起小腿骨筋膜室综合征。桡骨远端骨折（B错）是指距离桡骨远端关节面3cm以内的骨折，没有形成骨筋膜室的条件，不会引起骨筋膜室综合征。